某学者对200名肿瘤患者采用手术加放疗，其疗效与3年前只采用手术治疗效果进行比较。这种方法属于
A. 自身对照
B. 队列分析
C. 病理对照研究
D. 横断面调查
E. 历史对照

正确答案：E。历史对照

解析：历史对照临床试验是将一组患者作为试验组接受新疗法，其疗效与过去某时期用某疗法治疗的同类患者（对照组）相比较，以判断新疗法的效应。因此，对200名肿瘤患者采用手术加放疗，其疗效与3年前只采用手术治疗效果进行比较，属于历史对照（E对）。